新生儿颌骨骨髓炎感染来源多为
A. 牙源性
B. 腺源性
C. 损伤性
D. 血源性
E. 医源性

正确答案：D。血源性

解析：新生儿颌骨骨髓炎的感染来源多为血源性，但亦可因牙龈损伤或母亲患化脓性乳腺炎，哺乳时病原菌直接侵入而引起。患泪囊炎或鼻泪管炎时也可伴发上颌骨骨髓炎。掌握“口腔颌面部感染概论”知识点。